下列关于心身疾病的诊断标准表述最正确的是
A. 有明确的临床症状、体征
B. 有明确的病理学改变
C. 有明确的心理社会因素，并且与上述改变构成因果关系
D. 排除神经症、精神病和理化、生物学因素引起的疾病
E. 以上都是

正确答案：E。以上都是

解析：心身疾病的诊断标准①有明确的临床症状、体征和病理学改变。②有明确的心理社会因素，并且与上述改变构成因果关系。③排除神经症、精神病和理化、生物学因素引起的疾病。掌握“心身疾病”知识点。